朱砂安神丸组成中不含有的药物是
A. 黄连
B. 生地黄
C. 白芍
D. 当归
E. 甘草

正确答案：C。白芍

解析：本题考查朱砂安神丸的药物组成，记忆即可。朱砂安神丸由朱砂、黄连（A对）、炙甘草（E对）、生地黄（B对）、当归（D对）组成，没有白芍（C错，为本题正确答案）。方歌：朱砂安神东垣方，归连甘草合地黄，怔忡不寐心烦乱，养阴清热可复康。